为了保证软胶囊剂囊壁的可塑性，干明胶、干增塑剂和水的最适宜重量比例
A. 1∶（0.2～0.4）∶1
B. 1∶（0.4～0.6）∶1
C. 1∶（0.6～0.8）∶1
D. 1∶（0.8～1.0）∶1
E. 1∶（1.0～1.2）∶1

正确答案：B。1∶（0.4～0.6）∶1

解析：本题考查软胶囊剂的配置比例。为了保证软胶囊剂囊壁的可塑性，干明胶、干增塑剂和水的最适宜重量比例1∶（0.4～0.6）∶1。囊壁具有可塑性与弹性是软胶囊剂的特点，也是剂型成立的基础，它由明胶、增塑剂、水三者所构成，其重量比例通常是，干明胶：干增塑剂：水=1∶（0.4～0.6）∶1。若增塑剂用量过低或过高，囊壁就会过硬或过软。